水中总固体是指
A. 水中溶解性物质的总称
B. 水中悬浮性物质的总称
C. 水中有机物的总称
D. 水中无机物的总称
E. 水中所有无机和有机物质的总量

正确答案：E。水中所有无机和有机物质的总量

解析：本题考查水中总固体。水中总固体是指水中所有无机和有机物质的总量（E对ABCD错），包括溶解性物质、悬浮性物质、有机物和无机物等。